有关心脏起搏点的叙述,正确的是
A. 仅窦房结产生冲动
B. 仅房室结产生冲动
C. 当窦房结冲动产生受阻时房室结也可产生冲动,但节奏较慢
D. 希氏束产生冲动
E. 结间束产生冲动

正确答案：C。当窦房结冲动产生受阻时房室结也可产生冲动,但节奏较慢

解析：房室结是最重要的次级起搏点，当窦房结冲动产生受阻时房室结也可产生冲动, 但节奏较慢（C对）。